女孩，1岁，生后2月口周发绀，今晨哭闹后发绀加重，意识丧失四肢颤动，持续1分钟缓解，胸骨左缘第2-4肋间3/6收缩期杂音，双下肢无水肿，神经系统正常，胸部X线显示心尖上翘，肺动脉凹陷。意识丧失的原因为
A. 法洛四联症并肺脓肿
B. 法洛四联症并缺氧
C. 法洛四联症并肺水肿
D. 法洛四联症并心衰
E. 法洛四联症并急性肺炎

正确答案：B。法洛四联症并缺氧

解析：女孩，1岁，生后2月口周发绀，今晨哭闹后（缺氧常见加重因素）发绀加重，意识丧失四肢颤动（缺氧表现），持续1分钟缓解，胸骨左缘第2-4肋间3/6收缩期杂音（肺动脉瓣狭窄典型杂音），双下肢无水肿，神经系统正常，X线心尖上翘，肺动脉凹陷（法洛四联症典型X线征象），故患者考虑诊断为法洛四联症，其意识丧失的原因为法洛四联症并缺氧（B对）。法洛四联症并肺脓肿（A错）一般可见发热、咳脓臭痰，X线可见液平。法洛四联症并肺水肿（C错）一般可见咳粉红色泡沫痰，听诊可闻及湿罗音。法洛四联症并心衰（D错）一般有体循环淤血征象，可见下肢水肿、颈静脉回流征阳性等表现。法洛四联症并急性肺炎（E错）一般可见发热、咳嗽、咳痰等表现。